患者瘿肿质软，或大或小，心悸不宁，心烦不寐，目眩手颤，多食消瘦，口干咽燥，恶热多汗，舌红少苔，脉细数。其证型是
A. 心肝阴虚
B. 心脾两虚
C. 心胆气虚
D. 心肾阴虚
E. 心阴亏虚

正确答案：A。心肝阴虚

解析：患者瘿肿质软，或大或小，心悸不宁，心烦不寐，病位在心；目眩手颤，病位在肝；多食消瘦，口干咽燥，恶热多汗，舌红少苔，脉细数，舌脉可知为阴虚；综上可见证型属于瘿病心肝阴虚证（A对）。心脾两虚多见心悸不宁，面色萎黄，食少，便溏等症状（B错）。心胆气虚多见于心悸不安，失眠多梦，少气懒言等（C错）。心肾阴虚多有心悸心慌，腰膝痠软，耳鸣目眩等症状（D错）。心阴亏虚症见心悸失眠，盗汗，舌红少苔等（E错）。